某女患者，40岁，企图自杀，服用大量巴比妥致严重中毒，送来医院时，呼吸已经停止。马上对病人进行洗胃，无效。在没有其他对抗措施的条件下，采用了在当时还没有推广的人工肾透析治疗法进行抢救，收到了很好的疗效。为了抢救病人，采用了治疗性试验。对此做法，下面说法错误的是
A. 动机是好的，但得失结果一时难以下结论
B. 是符合医学道德的医学行为
C. 即使是抢救成功，也不合乎道德规范
D. 即使不幸造成死亡或伤残，也不能逆推动机不好
E. 本案例医生的选择是正确的

正确答案：C。即使是抢救成功，也不合乎道德规范